遇下列情况，首先应抢救
A. 肝破裂
B. 昏迷
C. 脾破裂
D. 张力性气胸
E. 开放性骨折

正确答案：D。张力性气胸

解析：本题考查创伤和战伤。创伤如并发遇其他情况，必须优先抢救的急症：主要包括心跳、呼吸骤停，窒息、大出血、张力性气胸（D对）和休克等。常用的急救技术主要有复苏、通气、止血、包扎、固定和后送等。